应激时纤维蛋白原的增加
A. 增强抗出血能力
B. 增强抗感染能力
C. 两者均可
D. 两者均否
E. 无

正确答案：A。增强抗出血能力

解析：增强抗出血能力（A对）是应激时纤维蛋白原的增加的作用。